坐姿从事精细作业时腰部承受的负荷主要是
A. 手持物体产生的负荷
B. 运动产生的负荷
C. 姿势负荷
D. 用力产生的负荷
E. 负重负荷

正确答案：C。姿势负荷